男性，40岁。右侧下颌骨磨牙区及下颌角处出现无痛性、逐渐膨大的肿块7年，生长缓慢。扪之有乒乓球感，无明显触痛。口内检查见右侧磨牙发生移位。X线片示：多房性囊性阴影，边缘不整齐呈半月形切迹状，无明显钙化灶影像。拟诊为成釉细胞瘤，此肿瘤扩大切除以便预防复发的原因是
A. 肿瘤太大
B. 肿瘤常易破坏骨质
C. 肿物易发生转移
D. 肿瘤有局部浸润周围骨质的特点
E. 肿瘤易恶变

正确答案：D。肿瘤有局部浸润周围骨质的特点

解析：本题考查成釉细胞瘤的治疗。拟诊为成釉细胞瘤，此肿瘤扩大切除以便预防复发的原因是肿瘤有局部浸润周围骨质的特点（D对）。成釉细胞瘤有局部浸润周围骨质的特点，因此成釉细胞瘤手术治疗时不应行刮除术，须将肿瘤周围的骨质至少在0.5cm处切除。否则，治疗不彻底易导致复发，而且多次复发后有可能变为恶性。